属于楔状缺损的对症治疗的是
A. 改正刷牙方法
B. 避免横刷
C. 选用较软的牙刷
D. 改正喜吃酸食习惯
E. 脱敏疗法

正确答案：E。脱敏疗法

解析：本题考查楔状缺损。楔状缺损的对症治疗：有牙本质过敏症者，应用脱敏疗法（E对）。有牙髓或根尖周病时，可行相应治疗。